具有咪唑并吡啶结构的药物是
A. 舒必利
B. 异戊巴比妥
C. 唑吡坦
D. 氟西汀
E. 氯丙嗪

正确答案：C。唑吡坦

解析：本题考查非苯二氮䓬类药物。具有咪唑并吡啶结构的药物是唑吡坦（C对）。唑吡坦为非苯二氮䓬结构的镇静催眠药，分子中含有咪唑并吡啶结构。舒必利（A错）为苯酰胺类抗精神病药，具有酰苯胺结构；异戊巴比妥（B错）为巴比妥类镇静催眠药，药物分子中含有丙二酰脲结构。氟西汀（D错）为5-羟色胺再摄取抑制剂类抗抑郁药，结构中无咪唑和吡啶结构；氯丙嗪（E错）为吩噻嗪类抗精神病药，含有二苯并噻嗪结构。